患者，左上6缺失，左上7单端桥，诉修复后基牙出现疼痛，X线片检查牙周膜增宽，应做的处理是
A. 调（牙合）
B. 口服消炎药
C. 局部上药
D. 拆除固定桥，重新设计修复方案
E. 不做任何处理

正确答案：D。拆除固定桥，重新设计修复方案

解析：第一磨牙所受颌力最大，设计第二磨牙的单端固定桥，超过了基牙承受的限度，引起牙周组织炎症，基牙疼痛，此时必须拆除固定桥，重作修复设计。掌握“固定桥修复后出现的问题及处理”知识点。